含有毒成分的中成药联合应用时，应注意有毒成分的“叠加”，以免引起不良反应。因药物组成含附子，不宣与大活络丸联用的中成药是
A. 天麻丸
B. 苏合香丸
C. 天王补心丸
D. 牛黄清心丸
E. 牛黄醒消丸

正确答案：A。天麻丸

解析：本题考查的是含有毒药物中成药的联用。含有毒成分的中成药联合应用时，应注意有毒成分的“叠加”，以免引起不良反应。因药物组成含附子，不宣与大活络丸联用的中成药是天麻丸（A对）。含有毒药物中成药的联用：数种功效相似的中成药联用，在各自制剂的组成中，往往有一种或几种相同的药味。因此，联用将会增加某一味或几味药的剂量。如大活络丸与天麻丸合用，两者均含附子；朱砂安神丸与天王补心丸（C错）合用，两者均含朱砂，均会增加有毒药味的服用量，加大患者产生不良反应的危险性。故在使用时应考虑药物“增量”的因素。再如复方丹参滴丸和速效救心丸同属气滞血瘀型用药，其处方组成与功效基本相似，而且这一类的药物多数含有冰片，由于冰片药性寒凉，服用剂量过大易伤人脾胃，导致胃痛胃寒，故不可过量使用，在临床应用中使用其中一种即可。因此中成药之间的联合用药。尤其是几种含有毒成分或相同成分的中成药联合应用时，应注意有毒成分或相同成分的“叠加”，以免引起不良反应。苏合香丸（B错）含丁香（母丁香）不能与含郁金的中成药联用。利胆中成药利胆排石片、胆乐胶囊、胆宁片等都含有郁金，若与六应丸、苏合香丸、妙济丸、纯阳正气丸、紫雪散等含丁香（母丁香）的中成药同时使用，就要注意具“十九畏”药物的禁忌。牛黄清心丸（D错）含雄黄与朱砂类成分、牛黄醒消丸（E错）含雄黄，应用时宜需注意避免重复用药。